既燥湿杀虫，又温肾壮阳的药是
A. 雄黄
B. 铅丹
C. 仙茅
D. 蛇床子
E. 淫羊藿

正确答案：D。蛇床子

解析：本题考查蛇床子的功效。既燥湿杀虫，又温肾壮阳的药是蛇床子（D对）。蛇床子【功效】燥湿祛风，杀虫止痒，温肾壮阳。雄黄（A错）【功效】解毒，杀虫，燥湿祛痰，截疟定惊。铅丹（B错）【功效】外用拔毒止痒，敛疮生肌；内服坠痰镇惊，攻毒截疟。仙茅（C错）【功效】补肾壮阳，强筋健骨，祛寒除湿。淫羊藿（E错）【功效】补肾阳，强筋骨，祛风湿。